患者，男，41岁。一身面目俱黄，黄色鲜明，腹微满，口渴，小便不利，舌苔黄腻，脉沉数。治疗应首选
A. 三仁汤
B. 茵陈蒿汤
C. 萆解分清饮
D. 蒿芩清胆汤
E. 甘露消毒丹

正确答案：B。茵陈蒿汤

解析：患者一身面目俱黄，黄色鲜明，腹微满，口渴，小便不利，舌苔黄腻，脉沉数。方用茵陈蒿汤。为治疗湿热黄疸之常用方。茵陈苦泄下降，清热利湿；栀子清热降火，通利三焦；大黄泻热逐瘀，通利大便，导瘀热从大便而下（B对）。三仁汤为治疗湿温初起，邪在气分，湿重于热的常用方剂（A错）。蒿芩清胆汤为治疗少阳湿热证的代表方（D错）。萆解分清饮为清热利湿之方（D错）。甘露消毒丹为治疗湿温时疫，湿热并重之证（E错）。趣记：茵陈蒿汤治黄——茵陈蒿汤栀黄。